哮喘未发作时，食少纳呆，大便不实，倦怠无力，或有咳嗽痰多，其治法是
A. 补肾纳气
B. 补肺固卫
C. 健脾化痰
D. 温肺化痰，止咳平喘
E. 回阳固脱，温肺平喘

正确答案：C。健脾化痰

解析：根据本病例患者“哮喘未发作时”，当处于支气管哮喘缓解期。根据其“食少纳呆，大便不实，倦怠无力，或有咳嗽痰多”可诊断为支气管哮喘缓解期之脾气虚弱证，治以健脾化痰（C对）。补肾纳气（A错）为哮喘之肾虚不纳证的治法。补肺固卫（B错）为哮喘之肺气虚弱证的治法。温肺化痰，止咳平喘（D错）寒性哮喘的治法。回阳固脱，温肺平喘（E错）为哮喘之喘脱危证的治法。